影响毒物经皮吸收的因素是
A. 毒物的脂溶性
B. 毒物的浓度和黏稠度
C. 接触的皮肤部位、面积
D. 外界气温、气湿
E. 以上都是

正确答案：E。以上都是